旋覆花的功效是
A. 燥湿化痰，消痞散结
B. 泻肺平喘，利水消肿
C. 温肺祛痰，利气散结
D. 消痰行水，降逆止呕
E. 清肺化痰，软坚散结

正确答案：D。消痰行水，降逆止呕

解析：本题考查的是旋覆花的功效。旋覆花的功效是消痰行水，降逆止呕（D对）。旋覆花：【功效】消痰行水，降气止呕。半夏：【功效】燥湿化痰，降逆止呕（A错），消痞散结。葶苈子：【功效】泻肺平喘，利水消肿（B错）。芥子：【功效】温肺祛痰，利气散结（C错），通络止痛。海蛤壳：【功效】清热化痰，软坚散结（E错），利尿消肿，制酸止痛。